下列哪项不宜用三棱针治疗
A. 高热
B. 脱证
C. 昏迷
D. 惊厥
E. 咽痛

正确答案：B。脱证

解析：该题考查三棱针法的适应范围及注意事项。熟悉三棱针放血疗法主治病证后可用排除法得出答案。脱证为虚证，不可用三棱针放血治疗。A、C、D、E选项都属于三棱针治疗范围（B错，为本题正确答案）。